食物中毒暴发时间的确定
A. 第一例病人症状出现的时间
B. 最后一例病人症状出现的时间
C. 发病高峰向前推一个平均潜伏期为爆发时间
D. 发病高峰向后倒推一个最短潜伏期为爆发时间
E. 发病高峰向后倒推一个最长潜伏期为爆发时间

正确答案：C。发病高峰向前推一个平均潜伏期为爆发时间

解析：本题考查暴露时间的估算。暴露时间的估算方法为：①从首例病例发病日期向前推一个最短潜伏期；②从病例高峰向前推一个平均潜伏期（C对ABDE错）；③从末例病例向前推一个最长潜伏期。